根呈圆柱形，平直和稍弯曲，两端平截，粗细均匀。表面类白色或淡红掠色，平滑，可见横长的皮孔痕。质坚实，角质样，切断面类白色或微棕红色，形成层环明显。具有以上特征的生药是
A. 防己
B. 白芷
C. 牛膝
D. 白芍
E. 黄芪

正确答案：D。白芍

解析：本题考查的是白芍药材的性状鉴别。根呈圆柱形，平直和稍弯曲，两端平截，粗细均匀。表面类白色或淡红掠色，平滑，可见横长的皮孔痕。质坚实，角质样，切断面类白色或微棕红色，形成层环明显。具有以上特征的生药是白芍（D对）。白芍：【性状鉴别】药材呈圆柱形，平直或稍弯曲，两端平截。表面类白色或淡红棕色，光洁或有纵皱纹及细根痕，偶有残存的棕褐色外皮。质坚实，不易折断，断面较平坦，类白色或略带棕红色，形成层环明显，射线放射状。气微，味微苦、酸。防己（A错）：【性状鉴别】药材呈不规则圆柱形、半圆柱形或块状，多弯曲。表面淡灰黄色，在弯曲处常有深陷横沟而成结节状的瘤块样。体重，质坚实，断面平坦，灰白色，富粉性，有排列较稀疏的放射状纹理。气微，味苦。白芷（B错）：【性状鉴别】药材呈长圆锥形。顶端有凹陷的茎痕，根头部钝四棱形或近圆形；表面灰黄色至黄棕色，具纵皱纹、支根痕及皮孔样横向突起，习称“疙瘩丁”，散生或排列成四纵行。质坚实，断面白色或灰白色，粉性，形成层环棕色，近方形或近圆形，皮部散有多数棕色油点，气芳香，味辛、微苦。牛膝（C错）：【性状鉴别】药材呈细长圆柱形，挺直或稍弯曲。表面灰黄色或淡棕色，有微扭曲的细纵皱纹、排列稀疏的侧根痕和横长皮孔样突起。质硬脆，易折断，受潮后变软，断面平坦，淡棕色，略呈角质样而油润，中心维管束木质部较大，黄白色，其外周散有多数黄白色点状异型维管束，习称“筋脉点”，断续排列成2～4轮。气微，味微甜而稍苦涩。黄芪（E错）：【性状鉴别】药材呈圆柱形，有的有分枝，上端较粗。表面淡棕黄色或淡棕褐色，有不整齐的纵皱纹或纵沟。质硬而韧，不易折断，断面纤维性强，并显粉性，皮部黄白色，木部淡黄色，具放射状纹理及裂隙。老根中心偶呈枯朽状，黑褐色或呈空洞。气微，味微甜，嚼之微有豆腥味。